甲型肝炎的主要传播途径是
A. 粪-口途径传播
B. 母婴垂直传播
C. 医源性传播
D. 性接触传播
E. 空气传播

正确答案：A。粪-口途径传播

解析：本题考查甲型肝炎的主要传播途径。甲型肝炎病毒主要通过粪-口途径传播（A对BCDE错），常见的传播途径有：经食物传播、经水传播和日常生活接触传播。